银翘解毒片适用于
A. 风寒感冒
B. 风热感冒
C. 外感风寒，内有食积
D. 夏令感冒，表寒里热
E. 外感风寒，乏力倦怠

正确答案：B。风热感冒

解析：本题考查的是银翘解毒片的主治。银翘解毒片适用于风热感冒（B对）。银翘解毒丸：【主治】风热感冒，症见发热、头痛、咳嗽、口干、咽喉疼痛。午时茶颗粒：【主治】外感风寒（A错）、内伤食积证（C错），症见恶寒发热、头痛身楚、胸脘满闷、恶心呕吐、腹痛腹泻。主治为夏令感冒，表寒里热（D错）或外感风寒，乏力倦怠（E错）的中成药，2022年考试指南未明确说明。